三叉神经痛的主要病理表现是
A. 脱髓鞘改变
B. 退行性变
C. 轴突消失
D. 轴突节段性断裂
E. 神经细胞坏死

正确答案：A。脱髓鞘改变

解析：本题考查三叉神经痛的病理表现。三叉神经痛的主要病理表现是脱髓鞘改变（A对）。三叉神经痛的病理表现包括神经节细胞坏死（E错）、炎症性浸润、动脉粥样硬化及髓鞘病变等，其中主要病理表现为脱髓鞘改变。受损的髓鞘明显发生病变，失去原有的层次结构。有的髓鞘破碎形成椭圆形颗粒，甚至成粉末状，其内的轴突显得不规则并有节段性断裂（D错）改变；有的发生退行性变（B错）；有的轴突只剩残余物或消失（C错）。其中脱髓鞘改变与退行性变、轴突消失、轴突节段性断裂为上下位概念。